在药品批准文号中字母J表示
A. 生物制品
B. 中药
C. 化学药品
D. 体外化学诊断试剂
E. 进口药品分包装

正确答案：E。进口药品分包装

解析：本题考查的是药品批准文号的格式。在药品批准文号中字母J表示进口药品分包装（E对）。药品批准文号的格式为：国药准字H（Z、S、J）+4位年号+4位顺序号，其中H代表化学药品（C错），Z代表中药（B错），S代表生物制品（A错），J代表进口药品分包装。